某溺水患者，经抢救后血气分析结果如下：pH7.20，PaCO₂10.7kPa(80mmHg),HCO₃⁻27mmol/L,可诊断为
A. 代谢性碱中毒
B. 急性呼吸性酸中毒
C. 代谢性酸中毒
D. 急性呼吸性酸中毒合并代谢性碱中毒
E. 急性呼吸性酸中毒合并代谢性酸中毒

正确答案：B。急性呼吸性酸中毒

解析：急性呼吸性酸中毒（B对）时CO2在体内游留，使血浆H2C03浓度不断升高，机体可以通过血红蛋白的缓冲作用和红细胞内外的离子交换使HCO₃⁻浓度上升，但是作用十分有限，所以HCO₃⁻浓度往往在正常范围内，不足以维持HCO₃⁻和H2C03的正常比值，所以急性呼吸性酸中毒时pH往往低于正常值，呈失代偿状态。